女，18岁。心尖部隆隆样杂音，并于收缩晚期听见喀喇音。提示病变瓣膜弹性良好是
A. 心尖部杂音
B. 杂音的响度
C. 杂音的性质
D. 开瓣音
E. 杂音持续的时间

正确答案：D。开瓣音

解析：心尖部隆隆样杂音，提示二尖瓣狭窄；收缩晚期喀喇音提示二尖瓣脱垂，考虑该病人二尖瓣狭窄伴关闭不全，如若听到开瓣音，证明二尖瓣弹性尚好（D对）。开瓣音的存在可作为二尖瓣瓣叶弹性及活动尚好的间接指标（九版诊断学P153）。心尖部杂音（A错）提示二尖瓣病变。杂音的响度（B错）的影响因素主要是心肌收缩力与心室充盈程度，瓣膜位置高低，瓣膜的结构、活动性。杂音的性质（C错）是由于杂音的不同频率而表现出音调与音色的不同，可据此推断不同的病变。杂音持续的时间（E错）也可用于推断心脏病变，但不能就此说明瓣膜弹性。